关于淋巴管下列说法正确的是
A. 由毛细淋巴管汇集而成
B. 管腔无瓣膜
C. 无浅深之分
D. 最后注入同名静脉
E. 无

正确答案：A。由毛细淋巴管汇集而成

解析：淋巴管由毛细血管汇集而成（A对），淋巴管内有许多瓣膜用来防止淋巴液逆流（B错），淋巴管分浅淋巴管和深淋巴管（C错），全身各部淋巴管汇合成为9条淋巴干，分别是：成对的腰干、支气管纵隔干、锁骨下干、颈干和一条肠干，这9条淋巴干又汇合成为胸导管和右淋巴导管，分别注入左、右静脉角，并非注入同名静脉（D错）。